重型霍乱患者治疗关键是
A. 大量口服补液
B. 有效抗菌治疗
C. 短期应用糖皮质激素
D. 禁食
E. 快速静脉补液

正确答案：E。快速静脉补液

解析：霍乱主要表现为严重的吐泻，重型霍乱表现为重度脱水（失水约4000ml），易导致休克，因此其治疗关键是快速静脉补液（E对）。大量口服补液（A错）适用于轻型霍乱患者，也适用于本题患者在经过快速静脉补液治疗病情稳定、脱水程度减轻后。有效抗菌治疗（P177）（B错）亦是霍乱患者的治疗手段之一，但其重要性亚于快速静脉补液。短期应用糖皮质激素（C错）、禁食（D错）均不是霍乱患者的治疗手段。